以下关于甲型肝炎流行地区分布的描述错误的是
A. 甲型肝炎呈世界范围分布
B. 发展中国家甲型肝炎发病率高
C. 我国是甲型肝炎的高流行区
D. 不同甲型肝炎流行区的主要传播途径不同
E. 城市人群不易发生甲型肝炎暴发

正确答案：E。城市人群不易发生甲型肝炎暴发